六经传变的基本顺序为
A. 太阴，少阴，厥阴，太阳，阳明，少阳
B. 太阳，阳明，少阳，太阴，少阴，厥阴
C. 太阳，少阳，阳明，太阴，少阴，厥阴
D. 少阴，厥阴，太阴，太阳，阳明，少阳
E. 太阳，少阳，阳明，少阴，厥阴，太阴

正确答案：B。太阳，阳明，少阳，太阴，少阴，厥阴

解析：循经传是指按伤寒六经的顺序相传。太阳病不愈,传入阳明,阳明不愈,传入少阳；三阳不愈,传入三阴,首传太阴,次传少阴,终传厥阴。